某男，52岁，患黄疸月余，症见身目发黄、脘腹胀满、小便不利。医师选用茵陈五苓丸治疗，此因茵陈五苓丸的功能是
A. 温阳化气、利湿行水
B. 疏风散寒、解表清热
C. 清热利尿、补气健脾
D. 清湿热、利小便
E. 清热解毒、利尿通淋、益肾

正确答案：D。清湿热、利小便

解析：本题考查的是茵陈五苓丸的功能。患黄疸月余，症见身目发黄、脘腹胀满、小便不利。医师选用茵陈五苓丸治疗，此因茵陈五苓丸的功能是清湿热、利小便（D对）。茵陈五苓丸：【功能】清湿热，利小便。五苓散：【功能】温阳化气，利湿行水（A错）。感冒清热颗粒：【功能】疏风散寒，解表清热（B错）。肾炎四味片：【功能】清热利尿，补气健脾脾（C错）。三金片：【功能】清热解毒，利湿通淋，益肾（E错）。